下列各项，不属于支气管哮喘诊断标准的是
A. 反复发作喘息
B. 发作时可闻及以呼气相为主的哮鸣音
C. 症状可缓解
D. 残气量增加
E. 支气管舒张试验呈阳性

正确答案：D。残气量增加

解析：反复发作喘息、呼吸困难、胸闷或咳嗽（A对）；发作时在双肺可闻及散在或弥漫性以呼气相为主的哮鸣音（B对）；症状可经治疗缓解或自行缓解（C对）；支气管激发试验或运动试验阳性（E对）均是支气管哮喘诊断要点。残气量增加不属于支气管哮喘诊断要点（D错，为本题正确答案）。